药品批发企业在药品购销活动中履行合同不当，承担违约责任，属于
A. 刑事责任
B. 行政责任
C. 民事责任
D. 违宪责任
E. 行政处罚

正确答案：C。民事责任

解析：本题考查药品安全法律责任。药品批发企业在药品购销活动中履行合同不当，承担违约责任，属于民事责任（C对）。